HMG-CoA还原酶抑制剂是
A. 考来烯胺
B. 烟酸
C. 非诺贝特
D. 洛伐他汀
E. 普罗布考

正确答案：D。洛伐他汀